各肛柱上端连成的环形线称
A. 肛直肠线
B. 肛皮线
C. Hilton线
D. 肛梳
E. 肛直肠环

正确答案：A。肛直肠线

解析：肛直肠线(A对)为连接各肛柱上端的环形线，肛皮线(B错)为连接各肛柱与各肛瓣边缘的锯齿状环形线，Hilton线(C错)为白线，是肛梳下缘一条不甚明显的环行线，肛梳(D错)为齿状线下方一宽约1cm的环状区域，肛直肠环(E错)为肛门外括约肌的浅部和深部、直肠下份的纵行肌、肛门内括约肌以及肛提肌等共同构成的围绕肛管的强大肌环。